患儿5岁。8月10日开始发热，头痛，恶心呕吐一次，次日稀便三次，精神不振，抽搐一次。体检：急性热病容，嗜睡状，颈强（+），克氏征（++），WBC15.2×10⁹/L，脑脊髓液为无色透明，白细胞100×10⁶/L，中性80%。该患儿哪种诊断的可能性最大
A. 中毒性菌痢
B. 流行性脑脊髓膜炎
C. 结核性脑膜炎
D. 流行性乙型脑炎
E. 化脓性脑膜炎

正确答案：D。流行性乙型脑炎

解析：流行性乙型脑炎是由乙脑病毒引起的血液传染病，多见于夏秋季，10岁以下儿童发病率最高，临床上起病急，体温急剧上升至39～40℃，伴头痛、恶心和呕吐，部分病人有嗜睡或精神倦怠，并有颈项强直、深反射亢进、病理性锥体束征阳性等表现，实验室检查：⑴血象 白细胞总数常在10000～20000/mm3，中性粒细胞在80%以上；⑵脑脊液呈无色透明，压力仅轻度升高，白细胞计数增加，在50～500/mm3，病初以中性粒细胞为主。该患儿5岁。8月10日开始发热，头痛，恶心呕吐一次，次日稀便三次，精神不振，抽搐一次。体检：急性热病容，嗜睡状，颈强（+），克氏征（++），WBC15.2×10⁹/L，脑脊髓液为无色透明，白细胞100×10⁶/L，中性80%等表现符合流行性乙型脑炎（D对）的临床表现及实验室检查结果。而中毒性菌痢（A错）是急性细菌性痢疾的危重型，起病急骤，突然高热、反复惊厥、嗜睡、迅速发生休克、昏迷。多见于2～7岁健壮儿童，病死率高，故该患儿不考虑此病。流行性脑脊髓膜炎（B错）是由脑膜炎双球菌引起的化脓性脑膜炎，前驱期多有上呼吸道感染史，突发寒战高热、伴头痛、肌肉酸痛、食欲减退及精神萎缩等毒血症症状，后期可有剧烈头痛、频繁呕吐、狂躁以及脑膜刺激症状，血象白细胞总数一般在20000/mm3左右，中性粒细胞占80%～90%。脑脊液外观呈浑浊或脓样，白细胞计数达每立方毫米数千至数万，糖含量明显减少，故该患儿不考虑此病。结核性脑膜炎（C错）呈亚急性起病，不规则发热1～2周后才出现脑膜刺激征、惊厥或意识障碍等表现，后于昏迷前先有脑神经或肢体麻痹。有结核接触史、PPD阳性或肺部等其他部位结核病灶者支持结核性脑膜炎的诊断。脑脊液外观呈毛玻璃样，白细胞数多＜500×10⁶/L，分类以淋巴细胞为主，故该患儿不考虑此病。化脓性脑膜炎（E错）是各种化脓性细菌引起的脑膜炎症，部分患者累及脑实质。临床上以急性发热、惊厥、意识障碍、颅内压增高和脑膜刺激征为特征。部分患儿病前有数日上呼吸道或胃肠道感染病史，故该患儿不考虑此病。